关于肱三头肌，正确的是
A. 作用于肘关节，不作用于肩关节
B. 是肘关节唯一的伸肌
C. 受脊髓第四颈节支配
D. 主要作用是伸肘关节
E. 部分受腋神经支配

正确答案：D。主要作用是伸肘关节

解析：肱三头肌的主要作用是伸肘关节（D对），也协助肩关节伸及内收，即作用于肘关节，也作用于肩关节（A错），受桡神经支配，不受腋神经支配（E错），即受第5～8颈神经前支和第1胸神经前支的大部分纤维支配，而非脊髓第四颈节（C错）。肱三头肌并非肘关节唯一的伸肌（B错），肘后肌也是。